咳嗽痰多，色白而黏，容易咯出，舌苔白腻，脉滑，证属
A. 肺气虚
B. 肺阴虚
C. 脾肺两虚
D. 痰热郁肺
E. 痰浊阻肺

正确答案：E。痰浊阻肺

解析：本题考查的是喘证痰浊阻肺的症状。咳嗽痰多，色白而黏，容易咯出，舌苔白腻，脉滑，证属痰浊阻肺（E对）。喘即气喘、喘息。喘证是以呼吸困难，甚至张口抬肩、鼻翼扇动、不能平卧为特征的疾病。西医学的肺炎、支气管炎、肺气肿、肺源性心脏病、心源性哮喘以及癔病等发生呼吸困难时，可参考此内容辨证论治。痰浊阻肺证【症状】喘而胸满闷塞，甚则胸盈仰息，咳嗽，痰多黏腻色白，咳吐不利，兼有呕恶，食少，口黏不渴。舌苔白腻，脉滑或濡。痰热壅肺（D错）证【症状】喘咳气涌，胸部胀痛，痰稠黏色黄，或夹血痰，伴胸中烦闷、身热、有汗、口渴喜冷饮、咽干、面红、尿赤、便秘。舌质红，苔薄黄腻，脉滑数。